对磺胺类药物有严重过敏史的患者应避免使用的药物是
A. 十一酸睾酮
B. 西地那非
C. 特拉唑嗪
D. 坦洛新
E. 非那雄胺

正确答案：D。坦洛新

解析：本题考查坦洛新。对磺胺类药物有严重过敏史的患者应避免使用的药物是坦洛新（D对）。坦洛新适用于前列腺增生引起的排尿障碍，严重的磺胺类过敏患者应该避免使用坦洛新。十一酸睾酮（A错）适用于男性原发性、继发性性腺功能减退的替代治疗等，临床用于：①男性雄激素缺乏症（睾丸切除术后、性功能减退、生殖器功能不足、更年期）；②男孩体质性青春期延迟；③乳腺癌转移的姑息性治疗；④再生障碍性贫血的辅助治疗；⑤中老年部分性雄激素缺乏综合征；⑥女性进行性乳腺癌。西地那非（B错）为5型磷酸二脂酶抑制剂，用于治疗勃起功能障碍。特拉唑嗪（C错）为泌尿系统药，用于良性前列腺增生症和高血压的治疗。非那雄胺（E错）为5α还原酶抑制剂，用于治疗已有症状的良性前列腺增生症。